严重感染时患者基础能量消耗是
A. 20～24kcal/（kg·d）
B. 25～29kcal/（kg·d）
C. 30～35kal/（kg·d）
D. 36～40kcal/（kg·d）
E. 41～45kcal/（kg·d）

正确答案：B。25～29kcal/（kg·d）

解析：基础能量消耗为BEE，实际静息能量消耗为REE，REE值比BEE值高10%左右。正常人基本热卡需要量（即实际静息能量消耗REE）为25kal/（kg·d）。创伤、感染时视其严重程度REE约增加20%～30%（七版外科学教材P139）。综上，严重感染时患者基础能量消耗是25×1.2（1.3）÷1.1≈27.27（29.54），与选项中25～29kal/（kg·d）（B对）最为接近。需注意：此题按照七版外科学观点进行计算，正常人REE为25kal/（kg·d）。而现在的观点（九版外科学P100）认为：机体能量需要量（数值上等同于REE）的确定，对于非肥胖病人 25 ~30kcal/( kg·d ） 能满足大多数住院病人的能量需求。